药品代谢的主要部位是
A. 胃
B. 肠
C. 脾
D. 肝
E. 肾

正确答案：D。肝

解析：本题考查药物代谢的部位。药物代谢的主要部位是在肝脏（D对），它含有大部分代谢活性酶，是最重要的代谢器官；其他均不是药物主要的代谢部位（ABCE错）。